损伤一侧大脑皮质的躯体运动区，可导致
A. 对侧肢体瘫痪和肌张力减退
B. 对侧肢体瘫痪和肌张力增加
C. 对侧肢体瘫痪并
D. 有浅感觉障碍
E. 同侧共济运动障碍

正确答案：B。对侧肢体瘫痪和肌张力增加

解析：损伤一侧大脑皮质的躯体运动区，即损伤了一侧的上运动神经元，上运动神经元损伤后会导致对侧深反射亢进和肢体瘫痪，即肌张力增加和肢体瘫痪（B对）。肌张力增加是由于其失去高级控制所致，即损伤去除了皮质脊髓束对牵张反射的抑制作用。